可作为栓剂硬化剂的是
A. 巴西棕榈蜡
B. 尿素
C. 甘油明胶
D. 叔丁基羟基茴香醚
E. 羟苯乙酯

正确答案：A。巴西棕榈蜡

解析：本题考查栓剂的附加剂。巴西棕榈蜡（A对）可作为栓剂的硬化剂；尿素（B错）可作为助溶剂；甘油明胶（C错）可作为栓剂的水溶性基质；叔丁基羟基茴香醚（D错）可用作栓剂的抗氧化剂；羟苯乙酯（E错）可用作栓剂的防腐剂。